需要进行崩解时限检查的剂型是
A. 气雾剂
B. 颗粒剂
C. 胶囊剂
D. 软膏剂
E. 膜剂

正确答案：C。胶囊剂

解析：本题考查胶囊剂。胶囊剂（C对）需进行崩解时限检查；颗粒剂（B错）质量要求溶出度、释放度、含量均匀度等应符合要求，而凡规定检查溶出度、释放度或融变时限的制剂，不再进行崩解时限检查；气雾剂（A错）、软膏剂（D错）、膜剂（E错）均无需进行崩解时限检查。